属于顺式作用元件的是
A. 转录抑制因子
B. 转录激活因子
C. 增强子
D. 外显子
E. 内含子

正确答案：C。增强子